普查妇女乳腺癌时测量疾病的频率指标应选用
A. 发病率
B. 发病专率
C. 罹患率
D. 患病率
E. 感染率

正确答案：D。患病率

解析：本题考查患病率的应用。患病率（D对ABCE错）通常用来反映疾病的现患状况。 普查妇女乳腺癌时测量疾病的频率指标应选用时点患病率，患病率可按观察时间的不同分为时点患病率和期间患病率。